整合4P的营销策略是指在制定社会营销计划及其实施中综合考虑4P因素，其中4P因素中不包含的是
A. 产品
B. 价格
C. 时间
D. 地点
E. 促销

正确答案：C。时间